患者女性，23岁，发现颈前区单一肿块3个月，随吞咽上下活动，边界清楚，应首先考虑
A. 甲状腺腺瘤
B. 结节性甲状腺肿
C. 甲状腺肿
D. 甲状腺癌
E. 甲亢

正确答案：A。甲状腺腺瘤

解析：本题患者女性，23岁，发现颈前区单一肿块3个月，随吞咽上下活动，边界清楚，应首先考虑甲状腺腺瘤（A对）。结节性甲状腺肿早期无明显症状，甲状腺结节状肿大，并且甲状腺功能正常。后期因为甲状腺结节的异质性，临床症状也不一致，取决于结节性甲状腺肿的生长速度和有无甲状腺功能障碍。可有颈部疼痛及肿胀或压迫症状，伴有甲亢症状（B错）。甲状腺肿大 病程早期，甲状腺呈对称、弥漫性肿大，腺体表面光滑，质地柔软，随吞咽上下移动。后期在肿大腺体的一侧或两侧可扪及单个或多个结节，病程较长，发展缓慢。当囊肿样结节并发囊内出血时，可引起结节迅速增大，可伴有疼痛（C错）。甲状腺癌是最常见的甲状腺恶性肿瘤，临床特点是颈前正中或两侧出现质硬、表面高低不平肿块，不随吞咽动作而上下移动（D错）。甲亢有甲状腺弥漫性肿大，可触及震颤，伴有杂音，常有易激动、烦躁、心动过速、乏力、怕热、多汗、体重下降、食欲亢进、大便次数增多或腹泻以及月经稀少等症状（E错）。